以下的药物能够引起牙齿酸蚀症的是
A. 维生素E
B. 阿司匹林
C. 钙片
D. 葡萄糖
E. 维生素D

正确答案：B。阿司匹林

解析：一些pH较低的药物也可引起牙酸蚀症，例如维生素C片剂、补铁剂、阿司匹林和一些治疗哮喘的药物。掌握“酸蚀症的预防”知识点。